下列药物中，使用前无需皮试的是
A. 苄星青霉素注射剂
B. 抑肽酶注射剂
C. 抗狂犬病血清注射剂
D. 紫杉醇注射剂
E. 普鲁卡因注射剂

正确答案：D。紫杉醇注射剂

解析：本题考查紫杉醇注射剂。使用前无需皮试的是紫杉醇注射剂（D对）。苄星青霉素注射剂（A错）、抑肽酶注射剂（B错）、抗狂犬病血清注射剂（C错）、普鲁卡因-青霉素注射剂（普鲁卡因）（E错）均需要做皮试，而紫杉醇注射剂使用前无需进行皮试。